眼球中膜前部是
A. 虹膜
B. 睫状体
C. 睫状小带
D. 晶状体
E. 脉络膜

正确答案：A。虹膜

解析：眼球从外向内依次分为眼球纤维膜、血管膜和视网膜3层，其血管膜即为眼球中膜。眼球血管膜由前至后又可分为虹膜、睫状体和脉络膜3部分，其虹膜即为前部。故虹膜（A对）是眼球中膜前部。